最容易引起出血性膀胱炎的抗癌药是
A. 氟尿嘧啶
B. 环磷酰胺
C. 博来霉素
D. 阿霉素
E. 紫杉醇

正确答案：B。环磷酰胺

解析：环磷酰胺（B对）属于烷化剂类抗癌药物，能与细胞的DNA、RNA或蛋白质中亲核集团起烷化作用，引起DNA结构和功能损害，在体内经肝药酶转化生成醛磷酰胺，在肿瘤细胞中分解出磷酰胺氮芥发挥作用，而另一代谢产物丙烯醛，具有膀胱毒性，容易引起出血性膀胱炎。氟尿嘧啶（A错）可影响肿瘤细胞核酸的合成发挥抗癌作用，对骨髓和消化道毒性较大，出现血性腹泻应立即停药，还可引起脱发、肝、肾损害等。博来霉素（C错）为含有多种糖肽的复合抗生素，可阻止DNA复制，干扰细胞分裂繁殖，主要不良反应为肺毒性，可出现间质性肺炎和肺纤维化。阿霉素（D错）抗肿瘤谱广，主要不良反应为骨髓造血毒性以及心脏毒性，严重时可出现心力衰竭。紫杉醇（E错）属于抗肿瘤植物药，能够促进微管聚合，抑制微观解聚，使纺锤体失去正常功能，细胞有丝分裂停止，主要不良反应为骨髓移植、神经毒性、心脏毒性和过敏反应。